HIV造成机体免疫功能损害主要侵犯的细胞是
A. CD⁴⁺淋巴细胞
B. CD8⁸⁺淋巴细胞
C. B淋巴细胞
D. NK细胞
E. 浆细胞

正确答案：A。CD⁴⁺淋巴细胞

解析：HIV感染人体的靶细胞是CD⁴⁺T淋巴细胞（A对），它通过感染免疫系统的中枢细胞CD⁴⁺淋巴细胞，激发异常的免疫反应，诱导有利于病毒繁殖的细胞因子微环境来扰乱整个免疫系统；CD ⁸⁺T淋巴细胞（B错）及其分泌的抗病毒因子是保护性免疫机制的主要组成部分，能够抑制病毒复制，并且具有对HIV特异的细胞溶解能力，在HIV感染初期具有抗病毒作用，因此受侵害较少；HIV感染后主要损伤人体免疫系统，T淋巴细胞和B淋巴细胞（C错）均可被累及，以T淋巴细胞受损为主；NK细胞（D错）能杀伤和溶解HIV感染的以及未受感染的细胞，在病毒感染早期的免疫应答中起重要作用；浆细胞（E错）由B细胞分化而来，HIV主要侵犯的是T淋巴细胞而不是B细胞。